化脓菌人血大量繁殖并扩散到其他器官引起新化脓灶，称为
A. 败血症
B. 毒血症
C. 内毒素血症
D. 脓毒血症
E. 菌血症

正确答案：D。脓毒血症